医学模式的转变要求医学教育在适应这一转变主要指
A. 医学生必须加强社会医学的学习
B. 医学生要掌握现代医学高技术在临床上的应用方法
C. 医学生必须精通英语和计算机技术
D. 医学生也要加强社会科学和人文科学知识的学习
E. 医学工作者首先是心理学、社会学专家

正确答案：D。医学生也要加强社会科学和人文科学知识的学习

解析：本题考查医学模式的转变。医学模式的转变要求医学教育在适应这一转变主要指医学生也要加强社会科学和人文科学知识的学习（D对ABCE错）。